我国化妆品卫生标准中对化妆品的一般要求包括多个方面，但不包括
A. 化妆品不得对皮肤和黏膜产生刺激作用
B. 化妆品不得对皮肤和黏膜产生感染
C. 化妆品不得对皮肤和黏膜产生损伤作用
D. 化妆品直接容器必须无毒
E. 化妆品必须使用安全

正确答案：D。化妆品直接容器必须无毒